Engel指数是指
A. （用于食品的开支/家庭总收入）×100%
B. 人均收入增长
C. （食物购买力增长%）/（收入增长%）
D. 年度食品深加工增长率
E. 人均收入增长率

正确答案：A。（用于食品的开支/家庭总收入）×100%